男性，20岁，平素健康，淋雨后突发寒颤、高热、头痛，第2天出现右侧胸痛、咳嗽、咳痰，胸片示右上肺大片实变影。体检不会出现的体征是
A. 右上肺叩诊浊音
B. 气管向左侧偏移
C. 右上肺语颤增强
D. 急性病容
E. 脉率增快

正确答案：B。气管向左侧偏移

解析：患者为青年男性，平素健康，淋雨后突发寒颤、高热、头痛（肺炎链球菌肺炎发病前常有淋雨、劳累史），第2天出现右侧胸痛、咳嗽、咳痰，胸片示右上肺大片实变影（为大叶性肺炎的典型表现），根据其临床表现和辅助检查，考虑诊断为肺炎链球菌肺炎。肺炎链球菌肺炎患者呈急性热病容（D对），口角及鼻周有单纯疱疹，病变广泛时可出现发绀。有脓毒症者，可出现皮肤、黏膜出血点，巩膜黄染。听诊可有呼吸音减低及胸膜摩擦音，肺实变时叩诊浊音（A对），触觉语颤增强（C对）并可闻及支气管呼吸音，消散期可闻及湿啰音。心率增快（E对），有时心律不齐。气管向左侧偏移（B错，为本题正确答案）一般见于右侧气胸、胸腔积液，链球菌肺炎一般气管居中。